男性，50岁。左胸闷气短2月，胸痛20天，夜间重，查体颜面及颈部胸壁略肿胀，胸壁静脉曲张，腋下有一拇指大小的淋巴结，无压痛，活动尚好，心率108次/分，律整，左肺呼吸音消失。诊断为
A. 心力衰竭
B. 冠心病心绞痛
C. 左自发性气胸
D. 左结核性胸膜炎
E. 左癌性胸膜炎

正确答案：E。左癌性胸膜炎

解析：患者为中老年男性，左胸闷气2月，胸痛20天，夜间重，查体颜面及颈部胸壁略肿胀，胸壁静脉曲张，腋下有一拇指大小的活动度好无压痛的淋巴结，左肺呼吸音消失等符合左癌性胸膜炎的临床表现及体格检查，故诊断为左癌性胸膜炎（E对）（癌性胸膜炎为胸内或胸外癌肿直接侵犯或转移到胸膜引起的，多无发热症状，有胸闷及进行性呼吸困难，胸液多为血性，并可找到癌细胞，可有淋巴结肿大等表现）。冠心病心力衰竭（P236）（A错）主要表现为呼吸困难、体力活动受限和体液潴留，一般不会出现胸壁静脉曲张，腋下无肿大的淋巴结、肺呼吸音消失等，且此类患者一般均有心律不齐。冠心病心绞痛（P219）（B错）主要表现为阵发性的前胸压榨性疼痛或憋闷感，主要位于胸骨后部，常发生于劳力负荷增加时，持续数分钟，休息或用硝酸酯类后疼痛消失。左自发性气胸（P120）（C错）可有突然加重的呼吸困难，并伴有明显发绀，患侧肺部为鼓音，听诊呼吸音减弱或消失，通过X线检查可以确诊。左结核性胸膜炎（P118）（D错）多见于青壮年，胸痛，并常伴有干咳、潮热、盗汗等结核中毒症状。